判断糖尿病血糖控制程度的指标是
A. 空腹血糖
B. 饭后血糖
C. 糖化血红蛋白
D. 空腹血浆胰岛素含量
E. OGTT

正确答案：C。糖化血红蛋白

解析：判断糖尿病血糖控制程度的指标是糖化血红蛋白，糖化血红蛋白能较稳定地反映采血前2～3个月内平均血糖水平（C对）。空腹血糖测定是病情变化观察、疗效追踪的关键性指标（A错）。用餐后血糖会自升高，饭后血糖不作为判断糖尿病血糖控制程度的指标（B错）。空腹血浆胰岛素含量测定主要用于了解胰岛细胞功能，协助判断糖尿病分型和指导治疗，也可协助诊断胰岛素瘤，但不能作为糖尿病的诊断依据（D错）。